“阳明温病，下之不通”，若因兼“邪闭心包”，而见“神昏舌短，内窍不通，饮不解渴”者，宜选用
A. 羚角钩藤汤加紫雪丹
B. 犀角地黄汤
C. 增液承气汤
D. 牛黄承气汤
E. 安宫牛黄丸

正确答案：D。牛黄承气汤

解析：吴氏认为：“下而至于不通，其为危险可知。”病至阳明，用攻下法，是治疗外感热病的关键点，在此失治，则土实而水亏，水亏则木旺，液涸风动，种种险候，可以接踵而至。“下之不通，其证有五”，说明单纯用攻下法未能取效，应考虑有其他病理因素存在。腑实兼有窍闭，出现神志昏迷，舌短缩，口渴而饮水不能解渴，则用牛黄承气汤（D对）清心开窍，通腑泻热。本方用安宫牛黄丸清心开窍，加生大黄末攻下腑实。